可逆转动脉粥样硬化，对合并缺血性心脏病的高血压患者提倡联合应用
A. 阿司匹林
B. 叶酸
C. 阿托伐他汀
D. 呋塞米
E. 布地奈德

正确答案：C。阿托伐他汀

解析：本题考查阿托伐他汀。可逆转动脉粥样硬化，对合并缺血性心脏病的高血压患者提倡联合应用阿托伐他汀（C对）。阿托伐他汀为他汀类调血脂药，能通过增加动脉粥样硬化斑块的稳定性或使斑块缩小而减少脑卒中或心肌梗死的发生。小剂量阿司匹林（A错）（75mg/d）有抗血栓形成作用，主要用于预防手术后血栓形成及心肌梗死。叶酸（B错）多用于合并同型半胱氨基酸血症的高血压患者。呋塞米（D错）为高效利尿剂，多用于高血压肾病患者。布地奈德（E错）为糖皮质激素，吸入给药可用于哮喘的治疗。